何种说法错误
A. 可纵向分为室周带、内侧带、外侧带
B. 与体温调节有关
C. 与交感和副交感有关
D. 与水盐代谢有关
E. 以上都正确

正确答案：E。以上都正确

解析：下丘脑位于背侧丘脑的前下方，纵向分为三带：室周带、内侧带、外侧带（A对）。功能上，下丘脑是内脏活动的高级调控中枢，其中①下丘脑内的由视上核、室旁核合成分泌的抗利尿激素与水盐代谢有关（D对）；②下丘脑与交感和副交感有关（C对），下丘脑前区内侧使副交感神经系统兴奋，下丘脑后区外侧使交感神经系统兴奋，通过背侧纵束和下丘脑脊髓束调控脑干和脊髓的自主神经活动；③与体温调节有关（B对），下丘脑前区、后区分别有热敏（对体温升高敏感）、冷敏（对体温降低敏感）神经元，当体温变化时上述神经元通过调节汗液分泌、表皮血管舒缩活动以适应温度变化。因而E为本题正确答案。